对异丙嗪，哪一项是错误的
A. 是H₁受体阻断药
B. 有明显的中枢抑制作用
C. 能抑制胃酸分泌
D. 有抗过敏作用
E. 有止吐作用

正确答案：C。能抑制胃酸分泌

解析：异丙嗪是吩噻嗪类抗组胺药，对中枢活性强、受体特异性差，故引致明显的镇静和抗胆碱作用表现为困倦、耐药、作用时间短、口鼻眼干等，但是对于胃酸分泌没有抑制作用。掌握“H₁、H₂受体阻断剂”知识点。